小儿结核性脑膜炎早期主要临床表现是
A. 脑膜刺激征阳性
B. 急性高热伴剧烈呕吐
C. 性格改变
D. 出现惊厥
E. 昏睡伴意识朦胧

正确答案：C。性格改变

解析：小儿结核性脑膜炎根据临床表现可分为3期：早期、中期、晚期。早期主要症状为性格改变（C对），如少言、懒动、易倦、烦躁、易怒等；中期，又称为脑膜刺激期，可有急性高热伴剧烈呕吐（B错），脑膜刺激征阳性（A错）；晚期，又称为昏迷期，可有昏睡伴意识朦胧（E错），阵挛性或强直性惊厥（D错）频繁发作。